酸枣仁汤中养肝血，安心神的药物是
A. 知母
B. 川芎
C. 茯苓
D. 甘草
E. 酸枣仁

正确答案：E。酸枣仁

解析：本题考查酸枣仁汤的方解。酸枣仁汤由酸枣仁、甘草、知母、茯苓、川芎组成。方中重用酸枣仁为君，以其甘酸质润，入心、肝之经，养血补肝，宁心安神（E对）。茯苓宁心安神为臣药（C错）。知母苦寒质润，滋阴润燥，清热除烦，为臣药（A错）。佐以川芎之辛散，调肝血而疏肝气，与大量之酸枣仁相伍，辛散与酸收并用，补血与行血结合，具有养血调肝之妙（B错）。甘草和中缓急，调和诸药为使（D错）。